感冒的主要症状有
A. 流鼻涕、打喷嚏，同时嗅觉减退
B. 疲乏、全身不适、有轻度发热或不发热、头痛、四肢痛
C. 呼吸困难、咳嗽、紫绀及咯血等，肺部可听到湿性罗音
D. 血常规检测白细胞计数正常或偏低
E. 高热不退，谵妄以致昏迷、儿童可见抽搐及脑膜刺激症状

正确答案：A、B、D。流鼻涕、打喷嚏，同时嗅觉减退；疲乏、全身不适、有轻度发热或不发热、头痛、四肢痛；血常规检测白细胞计数正常或偏低

解析：本题考查感冒的症状。感冒的主要症状有：流鼻涕、打喷嚏，同时嗅觉减退（A对）；疲乏、全身不适、有轻度发热或不发热、头痛、四肢痛（B对）；血常规检测白细胞计数正常或偏低（D对）。上感发病较急，初起时常有卡他症状，后期会出现全身症状。严重时可继发细菌感染，其临床表现为：1.全身可有畏寒、疲乏、无力、全身不适，有时有轻度发热或不发热、头痛、四肢痛、背部酸痛、食欲不振、腹胀、便秘等；小儿则可能伴有高烧、呕吐、腹泻等症状。2.病毒进入鼻黏膜细胞，释放出可引起发炎的物质，使鼻腔及鼻甲黏膜充血、流鼻涕或有水肿，同时嗅觉减退。3.打喷嚏，鼻中的神经末梢受到黏膜肿胀的刺激，经过反射而打喷嚏。4.咽部可有轻、中度充血，咽部肿痛、咽部干燥感、声音嘶哑和咳嗽等症状。5.血常规检测白细胞计数仍正常或偏低。当并发细菌性感染时，则血白细胞计数增多。